根据《传染病学防治法》，甲类传染病学除了霍乱外，还包括
A. 鼠疫
B. 麻风病
C. 百日咳
D. 流行性感冒
E. 流行性腮腺炎

正确答案：A。鼠疫

解析：根据《传染病学防治法》，甲类传染病学除了霍乱外，还包括鼠疫（A对）。麻风病是丙类传染病（B错）。根据传染病学防治法，属于乙类传染病学的是百日咳（C错）。流行性感冒是丙类传染病（D错）。流行性腮腺炎丙类传染病（E错）。